胸腺叙述错误的是
A. 甲状腺
B. 甲状旁腺
C. 分为左、右叶
D. 仅分泌胸腺素
E. 参与细胞免疫应答

正确答案：D。仅分泌胸腺素

解析：胸腺除了作为人体重要的中枢免疫器官之外，还同时具有内分泌功能，其分泌的泌胸腺素和促胸腺生成素，参与了机体的免疫反应，而不是仅分泌胸腺素（D错，为本题正确答案）。